患者牛某，心胸烦热，口渴面赤，意欲饮冷，口舌生疮，溲赤涩痛。方选
A. 桂苓甘露饮
B. 清暑益气汤
C. 竹叶石膏汤
D. 六一散
E. 导赤散

正确答案：E。导赤散

解析：“心胸烦热，面赤，口舌生疮”提示心经热盛，心火循经上炎；“口渴，意欲饮冷”是火热内灼，阴已不足的表现；“溲赤涩痛”是心热下移小肠，泌别失职，故此为心经火热证，治以清心利水养阴，方选导赤散（E对）。方中生地甘寒，凉血滋阴降火；木通苦寒，入心与小肠经，上清心经之火，下导小肠之热，两药相配，滋阴制火，利水通淋，共为君药。竹叶甘淡，清心除烦，淡渗利窍，导心火下行，为臣药。生甘草梢清热解毒，尚可直达茎中而止痛，并能调和诸药，还可防木通、生地之寒凉伤胃，为方中佐使。